易并发肺肉质变的是
A. 大叶性肺炎
B. 小叶性肺炎
C. 呼吸窘迫综合征
D. 肺梗死
E. 间质性肺炎

正确答案：A。大叶性肺炎

解析：大叶性肺炎（A对）时，若肺内炎性病灶中的中性粒细胞渗出过少，释放的蛋白酶量不足以溶解渗出的所有纤维素，未能被溶解吸收的纤维素将被肉芽组织取代发生机化，此时的肺组织呈褐色肉样外观，被称为肺肉质变。小叶性肺炎（P165）（B错）常并发肺脓肿。呼吸窘迫综合征（C错）常并发肺部多重细菌感染及多器官衰竭。肺梗死（P59）（D错）常并发纤维素性胸膜炎等。间质性肺炎（E错）可并发自发性气胸、呼吸衰竭等。